队列研究容易出现的重要偏倚是
A. 回忆偏倚
B. 测量偏倚
C. 选择偏倚
D. 失访偏倚
E. 混杂偏倚

正确答案：D。失访偏倚